肺热咳嗽，胃热呕吐，宜用
A. 苦杏仁
B. 竹茹
C. 百部
D. 桔梗
E. 瓜蒌

正确答案：B。竹茹

解析：竹茹甘，微寒；入肺、胃、心、胆经。可清热化痰，除烦，止呕。善于清化热痰，治肺热咳嗽，痰黄质稠者，常与黄芩、桑白皮等同用，以增强清热化痰功效；清热降逆止呕，为治胃热呕逆之要药（B对）。